姜黄除破血外，又能
A. 行气
B. 消积
C. 清心
D. 生肌
E. 安神

正确答案：A。行气

解析：本题考查姜黄的功效。姜黄除破血外，又能行气（A对）。姜黄【功效】破血行气，通经止痛。枳实【功效】破气消积（B错），化痰除痞。灯心草【功效】利尿通淋，清心（C错）除烦。乳香【功效】活血止痛，消肿生肌（D错）。茯苓【功效】利水渗湿，健脾，安神（E错）。